在消化道内吸收率较高、吸收速度较快的砷是
A. 5价砷
B. 3价砷
C. 一甲基胂
D. 二甲基胂
E. 三甲基胂

正确答案：A。5价砷

解析：本题考查在消化道内吸收率较高、吸收速度较快的砷。饮用水、粮食、蔬菜中的砷以三价或五价砷的形式经消化道摄入后，大部分在胃肠道吸收。在消化道内吸收率较高、吸收速度较快的砷是五价砷（A对BCDE错）。